下列哪项不是参与细胞内信息传递的第二信使物质
A. cAMP
B. 钙离子
C. IP3
D. DAG
E. ATP

正确答案：E。ATP

解析：参与细胞内信息传递的第二信使物质有环腺苷酸（cAMP）（A错）、环鸟苷酸（cGMP）、甘油二酯（DAG）（D错）、三磷酸肌醇（IP₃）（C错）、磷脂酰肌醇-3，4，5三磷酸（PIP₃）、钙离子（B错），它们可以作为外源信息在细胞内的信号转导分子。ATP（E对）是生物体内能量的利用与储存的中心，不参与细胞内信息传递。